女，65岁。反复咳嗽、咳痰20年，活动后气促5年，反复双下肢水肿6个月。1周前受凉后咳嗽、咳痰增多，气促加重，烦躁失眠。动脉血气分析：pH7.29，PaCO₂80mmHg，PaO₂55mmHg，BE+2.1mmol/L。应考虑的酸碱失衡状态为
A. 代偿性呼吸性酸中毒
B. 代偿性呼吸性碱中毒
C. 失代偿性呼吸性碱中毒
D. 失代偿性呼吸性酸中毒
E. 失代偿性代谢性酸中毒

正确答案：D。失代偿性呼吸性酸中毒

解析：pH正常值为7.35～7.45，处于该范围内为代偿性酸碱失衡，反之为失代偿性酸碱失衡。患者PH7.29小于正常值，因此为失代偿性酸中毒。PaCO₂正常值为35～45mmHg，该患者为PaCO₂80mmHg，因此为呼吸性酸中毒。剩余碱（BE）正常值为0±2.3mmol/L（说明：该BE正常值为教材标识，临床及考题多以0±3mmol/L为正常参考范围）。超出该范围正值表示机体代谢性碱中毒，反之，代谢性酸中毒。患者BE+2.1mmol/L正常。综上所述，患者处于失代偿性呼吸性酸中毒状态（D对）。